小儿“肝常有余”，故表现为
A. 感冒易导致肺气郁闭，发展成肺炎
B. 感冒一般症状较轻，预后较好
C. 感冒高热时容易引起惊厥
D. 感冒热多于寒
E. 感冒常夹痰，夹滞，夹惊

正确答案：C。感冒高热时容易引起惊厥

解析：小儿脏腑娇嫩，心神怯弱，肝气未盛，感邪之后，邪气易于枭张，从阳化热，由温及火，因而易见火热伤心生惊，伤肝引动肝风的证候。即所谓“心常有余”“肝常有余”。感冒高热时容易引起惊厥为“肝常有余”的表现（C对）。